急性风湿热患儿心尖区闻及2/6级杂音，可能的诊断是
A. 心肌炎
B. 心包炎
C. 心内膜炎
D. 无心脏侵犯
E. 上述均可发生

正确答案：C。心内膜炎

解析：风湿热患儿的心脏炎表现可表现为心肌炎、心内膜炎和心包炎，但产生心尖部2-3/6级杂音只能是侵犯二尖瓣，造成关闭不全，累及了瓣膜诊断为心内膜炎（C对）。风湿热所导致的心肌炎（A错）可产生奔马律、心尖部轻度收缩期吹风样杂音（未明确对杂音进行分级，故不作为最佳选项）及75% 的初发患儿主动脉瓣区可闻舒张中期杂音（九版儿科学P155）。风湿热所导致的心包炎（B错）可有心前区疼痛，心底部可闻及心包摩擦音（九版儿科学P155）。